各类型的结核病首选药是
A. 链霉素
B. 利福平
C. 异烟肼
D. 乙胺丁醇
E. 吡嗪酰胺

正确答案：C。异烟肼

解析：本题考擦异烟肼。异烟肼（雷米封）（C对），水溶性好且性质稳定。具有杀菌力强、不良反应少、可以口服且价格低廉的特点。对结核杆菌有高度的选择性，适合于各种类型的结核病患者均为首选药物。